是功能性动脉的是
A. 椎动脉
B. 颈内动脉
C. 面动脉
D. 胸廓内动脉
E. 肺动脉

正确答案：E。肺动脉

解析：肺动脉（E对）是运送血液至肺进行气体交换的功能性动脉。